为研究人群高血压患病率及其分布特点，在W市采用分层随机抽样方法抽取5个社区，对15岁以上的居民进行体检并填写健康调查问卷。该种研究属于
A. 分析性研究
B. 现况研究
C. 社区试验
D. 生态学研究
E. 队列研究

正确答案：B。现况研究